正确描述子宫主韧带的是
A. 位于子宫体两侧
B. 由子宫阔韧带被覆
C. 又称子宫颈旁组织
D. 是从子宫底延至盆侧壁的大量纤维组织束和平滑肌纤维
E. 是维持子宫前倾前屈位的重要结构

正确答案：B。由子宫阔韧带被覆

解析：子宫主韧带位于子宫颈两侧（A错），位于阔韧带的基部，由子宫阔韧带被覆（B对）。子宫主韧带又称子宫旁组织（C错）是从子宫颈延至盆侧壁的大量结缔组织束和平滑肌纤维组成（D错），是防止子宫脱垂重要结构（E错）。